抗利尿激素来源于
A. 腺垂体
B. 下丘脑的视上核和室旁核
C. 垂体柄中间部
D. 神经垂体
E. 漏斗部

正确答案：B。下丘脑的视上核和室旁核

解析：垂体的主要功能区包括腺垂体及神经垂体。腺垂体（A错）能合成及分泌激素：一类为生长激素（GH）及催乳素（PRL），；另一类为促激素，包括促甲状腺激素（TSH）、促肾上腺皮质分泌激素（ACTH）、卵泡刺激素（FSH）和黄体生成素（TH），于此，腺垂体与其上下级组织器官形成下丘脑-腺垂体-甲状腺轴、下丘脑-腺垂体-肾上腺皮质轴及下丘脑-腺垂体-性腺轴。神经垂体的内分泌，实际是指下丘脑视上核和室旁核（B对）投射于神经垂体（D错）储存、分泌，这些神经内分泌大细胞可合成血管升压素（VP）也称抗利尿激素（ADH）和缩宫素（OT）。